治疗和预防创伤发生气性坏疽的关键措施是
A. 注射破伤风抗毒素
B. 快速补液与输血
C. 应用大剂量青霉素
D. 即刻给予高压氧治疗
E. 尽早行彻底清创术

正确答案：E。尽早行彻底清创术

解析：治疗和预防创伤发生气性坏疽的关键措施是尽早彻底清创（E对），破伤风抗毒素为破伤风的治疗措施（A错）；补液、输血（B错）、大量应用抗生素（C错）、高压氧治疗（D错）均为气性坏疽的治疗措施，但最为关键的措施为尽早彻底清创。